临床上有的患牙探诊深度在正常范围，龈缘位于釉牙骨质界的根方，有轻度炎症而无明显的进展性表现，则可诊断为
A. 正常牙龈
B. 牙龈退缩
C. 牙龈炎
D. 牙周炎
E. 以上均不对

正确答案：C。牙龈炎

解析：本题考查牙周病的主要症状和临床病理。患牙探诊深度在正常范围，龈缘位于釉牙骨质界的根方，有轻度炎症而无明显的进展性表现应诊断为牙龈炎（C对）。正常牙龈（A错）无炎症反应，也无牙龈退缩（龈缘位于釉牙骨质界的冠方）。牙龈退缩（B错）龈缘位于釉牙骨质界的根方，探诊深度正常且牙龈应无炎症。牙周炎（D错）有牙周袋的形成，即使出现牙龈退缩，临床探诊深度也会大于3mm，炎症明显且有牙槽骨的进行性吸收。